造成先天性甲状腺功能低下的最主要的原因是
A. 碘缺乏
B. 甲状腺不发育或发育不全
C. 甲状腺合成过程中酶的缺乏
D. 促甲状腺激素缺乏
E. 甲状腺或靶器官反应性低下

正确答案：B。甲状腺不发育或发育不全

解析：散发性先天性甲状腺功能减退症的病因中，90%是甲状腺不发育或发育不全（B对），其他的病因有甲状腺激素合成障碍、TSH和TRH缺乏、甲状腺或靶器官反应低下、母亲因素等。碘缺乏、甲状腺合成过程中酶的缺乏、促甲状腺激素缺乏、甲状腺或靶器官反应性低下是造成先天性甲状腺功能低下的原因，但不是最主要原因（ACDE错）。